患者精神抑郁，表情淡漠，神志痴呆，语无伦次，不思饮食，舌苔腻，脉弦滑。其证候是
A. 肝气郁结
B. 痰气郁结
C. 痰火上扰
D. 风痰闭阻
E. 痰浊壅塞

正确答案：B。痰气郁结

解析：患者精神抑郁，表情淡漠，神志痴呆，语无伦次，故诊断为癫证；本病常由于思虑太过，所求不得，肝气被郁，脾气不升，气郁痰结，阻蔽神明，故表现精神抑郁，表情淡漠，神志痴呆，语无伦次这些精神异常的证候；痰浊中阻，故不思饮食，舌苔腻，脉弦滑，故其证候为痰气郁结证（B对）（ACDE错）。